下列因素可能引发口腔黏膜创伤性溃疡，除了
A. 进食烫面
B. 机械摩擦
C. 正畸钢丝
D. 咀嚼口香糖
E. 尖锐牙尖刺激

正确答案：D。咀嚼口香糖

解析：本题考查创伤性溃疡的病因。创伤性溃疡指由物理性、机械性或化学性刺激引起的病因明确的黏膜损害。咀嚼口香糖（D错，为本题的正确答案）不仅不会造成口腔黏膜的创伤性溃疡，还会起到清洁口腔、维护口腔卫生的作用。创伤性溃疡的病因有机械性刺激（B对），其中包括残冠残根、尖锐的边缘嵴和牙尖对黏膜的长期慢性刺激（E对），设计或制作不当的义齿引起的损伤，正畸钢丝（C对）若设计不当也会造成口腔黏膜的创伤性溃疡。还有冷热刺激伤，包括因饮料、开水、食物过烫如进食烫面（A对）引起黏膜灼伤，从而造成口腔黏膜的创伤性溃疡。